肌肤干燥，口燥咽干，唇燥而裂，尿少便结，脉细数，属
A. 阴虚证
B. 外燥证
C. 津液亏虚证
D. 精血不足证
E. 血虚证

正确答案：C。津液亏虚证

解析：本题考查的是津液不足证的临床表现。肌肤干燥，口燥咽干，唇燥而裂，尿少便结，脉细数，属津液亏虚证（C对）。津液不足证的临床表现，常见口渴咽干，唇燥舌干少津或无津，皮肤干燥，甚或干瘪，或见下肢痿弱，或小便短少，大便干结，脉多细数。若因高热灼伤津液，并见心烦、渴饮、舌红、苔黄、脉细数等症状。若气阴两伤，则并见气短、神疲、舌色较淡、苔少或光剥无苔、脉虚无力的症状。阴虚证（A错）的临床表现，除见形体消瘦、口燥咽干、眩晕失眠、舌红脉细数等阴液不足的症状外，还常伴见五心烦热、潮热盗汗、舌红绛、脉数等阴不制阳、虚热内生的症状。精血不足（D错）为肾精不足所致。肾精不足证的临床表现，常见男子精少不育，女子经闭不孕，性功能减退。小儿发育迟缓，身材矮小，智力和动作迟钝，囟门迟闭，骨骼痿软。成人早衰，发脱齿摇，耳鸣耳聋，健忘恍惚，动作迟缓，足痿无力，精神呆钝等。血虚证（E错）的临床表现，常见面色苍白或萎黄，唇色淡白，头晕眼花，心悸失眠，手足发麻，妇女经行量少、愆期甚或经闭，舌质淡，脉细无力。外燥证（B错）的临床表现，2020年考试指南未明确说明